可作为片剂黏合剂的是
A. 硬脂酸镁
B. 羧甲基淀粉钠
C. 乙基纤维素
D. 羧甲基纤维素钠
E. 硫酸钙

正确答案：C、D。乙基纤维素；羧甲基纤维素钠

解析：本题考查片剂的常用辅料。。黏合剂系指依靠本身所具有的黏性赋予无黏性或黏性不足的物料以适宜黏性的辅料，常用的黏合剂有淀粉浆、甲基纤维素（MC）、羟丙基纤维素（HPC）、羟丙基甲基纤维素 （HPMC）、羧甲基纤维素（CMC-Na）（D对）、乙基纤维素（EC）（C对）、聚维酮（PVP）、明胶、聚乙二醇（PEG）等。硬脂酸镁（A错）为润滑剂。羧甲基淀粉钠（B错）为崩解剂。硫酸钙（E错）为无机盐类的稀释剂。